绒毛膜癌与侵蚀性葡萄胎主要的鉴别依据是
A. 尿hCG阳性
B. 病理检查无绒毛结构
C. 有卵巢黄素化囊肿
D. 胸部X线片有棉团状阴影
E. 阴道有紫蓝色转移结节

正确答案：B。病理检查无绒毛结构

解析：侵蚀性葡萄胎（P338）镜下可见水泡状组织侵入子宫肌层，有绒毛结构及滋养细胞增生和异型性；绒毛膜癌（P338）镜下可见细胞滋养细胞和合体滋养细胞呈片状高度增生，明显异型，不形成绒毛或水泡状结构（B对）。无转移滋养细胞肿瘤（包括绒毛膜癌和侵蚀性葡萄胎）可有阴道出血、子宫复旧不全或不均匀性增大、卵巢黄素化囊肿（C错）、腹痛和假孕症状（尿中hCG阳性）（A错）等临床表现。转移性滋养细胞肿瘤（包括绒毛膜癌和侵蚀性葡萄胎）可发生肺转移，其X线胸片典型表现为棉球状或团块状阴影（D错）；也可发生阴道转移，阴道有紫蓝色转移结节（E错）；其他还可发生肝转移、脑转移等。